可以杀伤结核杆菌，最大限度降低传染性的早期杀菌活性药
A. 乙胺丁醇
B. 氨苄西林
C. 莫西沙星
D. 氧氟沙星
E. 吡嗪酰胺

正确答案：A。乙胺丁醇

解析：本题考查抗结核药。可以杀伤结核杆菌，最大限度降低传染性的早期杀菌活性药的是乙胺丁醇（A对）。迅速杀伤结核杆菌，最大限度降低传染性，主要品种有异烟肼、利福平、链霉素、阿米卡星、乙胺丁醇等。消灭组织内持留菌，最大限度减少复发，主要品种有利福平、吡嗪酰胺（E错）、异烟肼等。防止耐药有异烟肼、利福平、乙胺丁醇、氧氟沙星（D错）、左氧氟沙星、莫西沙星（C错）和克拉霉素。氨苄西林（B错）不作为抗结核的常用药物。